不能反映小气候对人体影响的生理指标是
A. 皮肤温度
B. 有效温度
C. 体温
D. 温热感觉
E. 热平衡测定

正确答案：B。有效温度

解析：本题考查小气候对人体影响的生理指标。小气候对人体影响的生理指标有：1.皮肤温度（A对）：皮温测定方法简便，并与人的温热感觉、脉搏变化基本上平行，是评价小气候对人体影响的常用生理指标；2.体温（C对）：体温是判断机体热平衡是否受到破坏的最直接的指标。由于人体具有较强的体温调节能力，除在很热或很冷清况下，机体的热平衡一般不易受到破坏，体温一般变化不大；3.脉搏：气温对机体的热调节起着主要的作用。在气温升高时，机体首先表现的是适应过程，皮肤毛细血管扩张，此时脉搏也随之加快。因此，脉搏在高温条件下是一种简单和灵敏的指标；4.出汗量：人体在任何气温下，皮肤表面均有汗液蒸发。但在气温较低时，出汗量少，自己感觉不到，即为不知觉出汗。在安静情况下，若相对湿度为22%，气温达30℃时，开始知觉出汗。知觉出汗是反映体温调节过程紧张的一项指标；5.温热感（D对）：温热感是一种主观感觉，反映机体在小气候作用下皮肤、鼻腔、口腔、咽喉黏膜等外感受器所感受的热和冷的综合感觉；6.热平衡测定（E对）：是了解机体在小气候作用下生理反应的一种重要方法，但因测量计算繁琐，一般不常使用。有效温度（B错，为本题正确答案）是小气候的综合评价指标。